某男，56岁，患高血压病服用吲达帕胺，后因血压控制不理想，自行加服珍菊降压片。近期感觉胸闷、心悸、乏力。到医院就诊。医师进一步告知，珍菊降压片除含上述西药成分外，还含有
A. 卡托普利
B. 硝苯地平
C. 氢氯噻嗪
D. 卡马西平
E. 米诺地尔

正确答案：C。氢氯噻嗪

解析：本题考查的是含西药组分的中成药。珍菊降压片除含盐酸可乐定外，还含有氢氯噻嗪（C对）。珍菊降压片：功能降压。用于高血压。含西药成分盐酸可乐定、氢氯噻嗪。卡托普利（A错）为抗高血压药。含硝苯地平（B错）、卡马西平（D错）与米诺地尔（E错）的中成药，2022年考试指南未明确说明。